作用于神经氨酸酶的抗病毒药物是
A. 磺胺甲噁唑
B. 来曲唑
C. 奥司他韦
D. 左氧氟沙星
E. 甲磺酸伊马替尼

正确答案：C。奥司他韦

解析：本题考查非核苷类抗病毒药。奥司他韦（C对）是作用于神经氨酸酶的抗流感病毒药物，通过抑制NA（去甲肾上腺素），能有效地阻断流感病毒的复制过程，对流感的预防和治疗发挥重要的作用。磺胺甲噁唑（A错）、左氧氟沙星（D错）均为抗菌药。甲磺酸伊马替尼（E错）为酪氨酸激酶抑制剂。